完全脱位牙不应保存于
A. 生理盐水
B. 牛奶
C. 舌下或口腔前庭
D. 消毒空瓶或纱布
E. 自来水

正确答案：D。消毒空瓶或纱布

解析：本题考查完全脱位牙的治疗。完全脱位牙不应保存于消毒空瓶或纱布（D错，为本题的正确答案）。对于完全脱位的牙，如果不能即刻复位，切忌干藏，用消毒空瓶或纱布干藏的脱位牙重新放回牙槽窝内不易存活。可将患牙置于患者的舌下或口腔前庭处（C对），也可放在盛有生理盐水（A对）、牛奶（B对）或自来水（E对）的杯子内。